十二指肠球部前壁溃疡最常发生的并发症是
A. 穿孔
B. 幽门梗阻
C. 胆囊炎
D. 胰腺炎
E. 出血

正确答案：A。穿孔

解析：十二指肠球部溃疡可并发穿孔、出血、幽门梗阻、胰腺炎等，穿孔最常见于球部前壁（A对），出血（E错）最常见于后壁。十二指肠球部溃疡反复发作可导致瘢痕性幽门梗阻（B错）。十二指肠球部溃疡一般不会引起胆囊炎（C错）。十二指肠球部穿透性溃疡可引起胰腺炎，但较少见（D错）。